女，55岁。体检发现颈部包块3个月。查体：气管右侧可扪及一质硬结节，表面不光滑，随吞咽上下移动，同侧胸锁乳突肌前缘可扪及2个肿大淋巴结。放射性核素扫描为“冷结节”。为进一步明确诊断，最好的检查是
A. 颈部增强CT
B. 甲状腺核素静态显像
C. 颈部彩色多普勒超声
D. 血清甲状腺素水平
E. 细针穿刺细胞学检查

正确答案：E。细针穿刺细胞学检查

解析：中年女性患者，体检发现颈部包块3个月。查体：气管右侧可扪及一质硬结节，表面不光滑，随吞咽上下移动（甲状腺癌典型体征），同侧胸锁乳突肌前缘可扪及2个肿大淋巴结（提示有转移）。放射性核素扫描为“冷结节”（提示恶性肿瘤），结合患者的症状、体征和实验室检查，该患者最可能的诊断是甲状腺髓样癌，为进一步明确诊断，最好的检查是细针穿刺细胞学检查（E对）。颈部增强CT（A错）一般可以检查颈部肿瘤、颈椎等疾病，但不作为甲状腺癌的首选检查。甲状腺核素静态显像（B错）虽然可以对甲状腺癌进行辅助诊断，但由于含有射线，一般不作为首选。颈部彩色多普勒超声（C错）一般用于区别甲状腺高功能腺瘤和结节性毒性甲状腺肿。血清甲状腺素水平（D错）一般可以用于辅助诊断甲亢、甲减等疾病。